心电图上Ⅰ和AVL导联出现急性心肌梗死的特异性改变，其梗死部位是心脏的
A. 下壁
B. 前壁
C. 后壁
D. 高侧壁
E. 前间壁

正确答案：D。高侧壁

解析：根据表3-4-4可知，高侧壁（D对）心肌梗死时心电图特异性改变出现在I和aVL导联。下壁（A错）心肌梗死时出现在Ⅱ、Ⅲ、aVF导联。前壁（B错）心肌梗死可出现在V₁～V₆导联，具体根据前壁梗死范围确定。后壁（C错）心肌梗死出现在V₇～V₉导联。前间壁（E错）心肌梗死出现在V₁～V₃导联。